不可能是地图舌的病因的是
A. 消化不良
B. 贫血
C. 胃肠功能紊乱
D. 口腔pH值改变
E. 情绪因素

正确答案：D。口腔pH值改变

解析：地图舌原因不明。在儿童与消化不良、肠寄生虫、维生素B族缺乏有关。在成人与贫血、胃肠功能紊乱、情绪、病灶感染等有关。还有报道与遗传因素有关。掌握“地图舌、沟纹舌及舌乳头炎”知识点。